在心理评估中，向被试者呈现一幅简单的几何图形，并要求被试者临摹，以观察其视觉空间能力。这种方法属于
A. 会谈法
B. 投射法
C. 问卷法
D. 观察法
E. 作业法

正确答案：E。作业法

解析：心理测验根据测验方法分为问卷法、作业法、投射法。作业法（E对）测验形式是非文字的，让受试者进行实际操作。对于婴幼儿及受文化教育因素限制的受试者（如文盲、语言不通的人或有语言残障的人等），心理测验中主要采用这种形式。投射法（B错）测验材料无严谨的结构，如一些意义不明的图像、一片模糊的墨迹或一句不完整的句子，要求受试者根据自己的理解随意作出回答，借以诱导出受试者的经验、情绪或内心冲突。投射法多用于测量人格，如洛夏测验、TAT等，也有用于异常思维的检测，如自由联想测验、填词测验等。问卷法（C错）测验多采用结构式问题的方式，让被试者以“是”或“否”或在有限的几种选择上作出回答。一些人格测验如MMPI、EPQ及评定量 表等都是采用问卷法的形式。心理评估的方法分为观察法（D错）、会谈法（A错）、调查法。